哮喘持续状态是指哮喘发作严重，时间持续在
A. 1小时
B. 3～4小时
C. 5～6小时
D. 8～12小时
E. 24小时以上

正确答案：E。24小时以上

解析：哮喘持续状态是指哮喘发作严重，时间持续在24小时以上（E对），经治疗不缓解者，患者呼吸困难加重，发绀，大汗淋漓，面色苍白，四肢厥冷，常因严重缺氧、二氧化碳潴留而致呼吸衰竭。1小时（A错）、3～4小时（B错）、5～6小时（C错）、8～12小时（D错）均不正确。